我国《中小学教室换气卫生标准》规定教室内空气中CO₂最高允许浓度为
A. 0.05%（50pm）
B. 0.10%（1000ppm）
C. 0.15%（1500ppm）
D. 0.20%（200ppm）
E. 0.25%（2500ppm）

正确答案：C。0.15%（1500ppm）